银汞合金中白合金粉由以下几种金属组成
A. 银、锡、铜、铅
B. 银、锡、铜、锌
C. 银、锡、铜、锰
D. 银、铜、锌、铁
E. 银、锡、锌、铝

正确答案：B。银、锡、铜、锌

解析：本题考查低铜银合金粉的组成。银汞合金分为低铜银合金粉和高铜银合金粉，其中低铜银合金粉（即银汞合金中白合金粉）主要由银、锡、铜、锌（B对）组成，铜含量不超过6%。高铜银合金粉铜含量超过6%。